非创伤性修复治疗（ART）的充填材料为
A. 流动树脂
B. 光固化复合树脂
C. 含氟的玻璃离子
D. 银汞合金
E. 复合体

正确答案：C。含氟的玻璃离子

解析：材料：玻璃离子粉、液，牙本质处理剂。掌握“非创伤性修复治疗”知识点。